城市自来水供水企业和自建设施对外供水的企业，其生产管理制度的建立和执行，人员上岗的资格和水质日常检测工作由哪个部门负责管理
A. 卫生行政主管部门
B. 建设行政主管部门
C. 城市建设主管部门
D. 城市卫生行政主管部门
E. 企业的上级主管部门

正确答案：C。城市建设主管部门